关于暴发，哪种说法是错误的
A. 在特定人群短时间内发生多例同一种疾病叫暴发
B. 暴发的疾病可以是传染病，也可以是非传染病
C. 暴发有集中同时的暴发，也有持续、蔓延的暴发
D. 暴发常由于许多人接触同一致病因子而引起
E. 暴发时病例发病日期不同是由于该病的传染期不同所致

正确答案：E。暴发时病例发病日期不同是由于该病的传染期不同所致